典型的苯丙酮尿症是因肝脏缺乏
A. 酪氨酸羟化酶
B. 谷氨酸羟化酶
C. 苯丙氨酸羟化酶
D. 二氢生物蝶呤还原酶
E. 羟苯丙酮酸氧化酶

正确答案：C。苯丙氨酸羟化酶